《公共交通工具卫生标准》对以下哪个指标没有具体要求
A. 供水设备
B. 噪声
C. 乘客人数
D. 卫生管理制度
E. 微小气候

正确答案：C。乘客人数

解析：本题考查公共交通工具卫生标准的指标。《公共交通工具卫生标准》规定了旅客列车车厢、轮船和飞机客舱内的微小气候（E对）、空气质量、噪声（B对）、照度的卫生标准、卫生管理制度（D对），防治病媒昆虫、粪便垃圾处理、供水设备（A对）、卧具更换、卫生清扫等做出要求。乘客人数（C错，为本题正确答案）不是《公共交通工具卫生标准》要求的指标。